肝细胞胞浆内嗜酸性小体
A. 细胞水肿
B. 脂质沉积
C. 结缔组织玻璃样变
D. 血管壁玻璃样变
E. 细胞内玻璃样变

正确答案：E。细胞内玻璃样变

解析：肝细胞发生嗜酸性变时，病变肝细胞由于胞质水分脱失浓缩使得体积变小，胞质嗜酸性增强，随着胞质的进一步浓缩，核也浓缩消失，最终形成深红色浓染的圆形小体，即嗜酸性小体。这一过程的本质是肝细胞凋亡，嗜酸性小体的形成是细胞内玻璃样变（E对）的结果。细胞水肿（A错）是病毒性肝炎（P197）时肝细胞最常见的病变。脂质沉积（B错）常见于慢性肝淤血（P16）等。结缔组织玻璃样变（C错）和血管壁玻璃样变（D错）也属于玻璃样变性（P17），前者常见于动脉粥样硬化纤维斑块及各种坏死组织的机化等；后者常见于缓进型高血压等。